丹毒的致病菌是
A. 蜡状芽孢杆菌
B. 白色念珠菌
C. 金黄色葡萄球菌
D. β-溶血性链球菌
E. 表皮葡萄球菌

正确答案：D。β-溶血性链球菌

解析：本题考查丹毒的致病菌。丹毒的致病菌是β-溶血性链球菌（D对）。蜡状芽孢杆菌（A错）引起食物中毒，中毒者症状为腹痛、呕吐腹泻。白色念珠菌（B错）引起鹅口疮等真菌感染。金黄色葡萄球菌（C错）可引起各种化脓性感染及食物中毒、烫伤样皮肤综合征、毒性休克综合征等毒素性疾病。表皮葡萄球菌（E错）为机会致病菌，可引起免疫缺陷者医院内感染（包括伤口感染和插管感染）。